小儿先天性心脏病最常见的类型是
A. 房间隔缺损
B. 室间隔缺损
C. 动脉导管未闭
D. 肺动脉瓣狭窄
E. 法洛四联症

正确答案：B。室间隔缺损

解析：室间隔缺损是小儿先天性心脏病最常见的类型，在小儿各类先天性心血管畸形的发病率中，该病居第一位，男多于女（B对）。房间隔缺损（A错）占先天性心脏病发病总数的5%～10%，女性多见。动脉导管未闭（C错）为小儿先天性心脏病常见的类型之一，占先天性心脏病发病总数的15%左右，女性较为多见。肺动脉瓣狭窄（D错）是单纯性右室流出道梗阻最常见的类型，其发病率占先天性心脏病的7%～10%。法洛四联症（E错）是1岁以后存活的婴幼儿中最常见的青紫型先天性心脏病，约占所有的先天性心脏病的10%。